联用治疗细菌性心内膜炎的是
A. 链霉素与异烟肼
B. 链霉素与磺胺嘧啶
C. 青霉素与链霉素
D. 青霉素与磺胺嘧啶
E. 氯霉素与丙种球蛋白

正确答案：C。青霉素与链霉素

解析：本题考查药物的联合应用。青霉素与链霉素联用治疗细菌性心内膜炎（C对）。青霉素可破坏细菌细胞壁的合成，链霉素可抑制细菌繁殖过程中蛋白质的合成，两者联用加强杀菌作用，用于治疗亚急性细菌性心内膜炎。链霉素与异烟肼（A错）联用治疗肺结核。链霉素或四环素与磺胺类（B错）联用治疗布氏杆菌病。青霉素与磺胺嘧啶（D错）一般不联用。氯霉素与丙种球蛋白（E错）联用治疗麻疹。